某女，35岁。月经提前，量少，色淡质稀，腰酸腿软，头晕耳鸣，小便频数。舌淡暗苔薄白，脉沉细。辨证为肾气虚证，治宜选用的方剂是
A. 固阴煎
B. 丹栀逍遥散
C. 圣愈汤
D. 杞菊地黄丸
E. 右归丸

正确答案：A。固阴煎

解析：本题考查的是月经先期的辨证论治。辨证为肾气虚证，治宜选用的方剂是固阴煎（A对）。月经先期肾气虚证：【方剂应用】基础方剂为固阴煎（人参、熟地、山药、山茱萸、远志、炙甘草、五味子、菟丝子）或归肾丸（熟地、菟丝子、山药、枸杞、茯苓、杜仲、山茱萸、当归）加减。丹栀逍遥丸（B错）为月经先期肝郁血热的方剂应用。月经先期肝郁血热：【方剂应用】基础方剂为丹栀逍遥散（丹皮、栀子、当归、白芍、柴胡、白术、茯苓、煨姜、薄荷、炙甘草）加减。圣愈汤（C错）是痛经气血两虚证的方剂应用。气血虚弱证：【方剂应用】基础方剂为圣愈汤（人参、黄芪、当归、川芎、熟地黄、白芍）加减。右归丸（E错）是绝经前后诸证脾肾阳虚证的中成药应用。绝经前后诸证脾肾阳虚证：【中成药应用】常用中成药有妇女养血丸、参茸白凤丸、八宝坤顺丸。方剂应用为杞菊地黄丸（D错）的病证，2022年考试指南未明确说明。